成牙骨质细胞瘤又称为
A. 混合性牙瘤
B. 牙源性腺样瘤
C. 组合性牙瘤
D. 成釉细胞纤维瘤
E. 真性牙骨质瘤

正确答案：E。真性牙骨质瘤

解析：成牙骨质细胞瘤又称为真性牙骨质瘤。掌握“牙源性黏液瘤、成牙骨质细胞瘤”知识点。